Weber综合征(大脑脚综合征）的临床表现为
A. 对侧动眼神经麻痹，对侧偏瘫
B. 同侧动眼神经麻痹，对侧偏瘫
C. 同侧动眼神经麻痹，同侧偏瘫
D. 对侧动眼神经麻痹，同侧偏瘫
E. 以上都不对

正确答案：B。同侧动眼神经麻痹，对侧偏瘫

解析：大脑脚综合征表现为同侧动眼神经麻痹，对侧偏瘫（B对）。